由抗中性粒细胞抗体引起
A. 自身免疫性血小板减少性紫癜
B. 自身免疫性中性粒细胞减少症
C. 重症肌无力
D. 肺出血肾炎综合征
E. 恶性贫血

正确答案：B。自身免疫性中性粒细胞减少症

解析：自身免疫性中性粒细胞减少症是由抗中性粒细胞抗体引起的中性粒细胞减少性疾病，患者易发生化脓菌感染。掌握“常见口腔自身免疫性疾病及自身免疫性疾病的治疗”知识点。